诱导染色体畸变的主要靶分子为
A. DNA
B. 纺缍丝
C. 中心粒
D. 微管蛋白

正确答案：A。DNA

解析：本题考查染色体畸变的相关内容。染色体畸变是指染色体的结构改变，是遗传物质较大范围的改变，是染色体或染色单体断裂及断裂的不正确重接所致。诱导染色体畸变的主要靶分子为DNA（A对BCD错）。